苏木的药用部位是
A. 茎藤
B. 茎枝
C. 茎刺
D. 茎髓
E. 心材

正确答案：E。心材

解析：本题考查的是苏木的来源。苏木的药用部位是心材（E对）。药用部位为木本植物的茎藤或仅用其木材部分，少数为草本植物茎藤，这类中药称“茎木类中药”。实际上应属于两类，即茎类中药和木类中药。（1）茎类中药：药用为植物的茎藤、茎枝、茎刺或茎的髓部，这类中药称“茎类中药”。药用为木本植物藤茎（A错）的，如川木通、大血藤、鸡血藤等；药用为带叶茎枝（B错）的，如桑寄生、槲寄生；药用为嫩枝的，如桂枝、桑枝等；药用为棘刺（C错）的，如皂角刺；药用为茎翅状附着物的，如鬼箭羽；药用为茎髓（D错）的，如通草、灯心草；药用为新鲜或干燥茎的，如石斛等。（2）木类中药：药用为木本植物茎形成层以内的部分，这类中药称为“木类中药”。其药用部位实际为木材。木材又分为边材和心材两部分。边材形成较晚，含水分较多，颜色较浅，亦称液材；心材形成较早，位于木质部内方，蓄积了较多的物质，如树脂、树胶、单宁、挥发油等，颜色较深，质地较致密。木类中药多采用心材部分，如沉香、降香、檀香、苏木等。